益胃汤适宜治疗疮疡的
A. 气血两虚证
B. 阴伤胃虚证
C. 热盛伤津证
D. 瘀血流注证
E. 湿伤脾胃证

正确答案：B。阴伤胃虚证

解析：益胃汤养胃益阴，用于疮疡阴伤胃虚者（B对）。气血两虚证（A错）应首选补益气血方。热盛伤津证（C错）治疗应选清热益津方。瘀血流注证（D错）的治疗重在活血化瘀。湿伤脾胃证（E错）治疗应以健脾祛湿为主。